为患者进行体格检查时医生首先应做到的是
A. 态度热情诚恳
B. 客观求实公正
C. 保守患者秘密
D. 尊重患者人格
E. 态度认真负责

正确答案：D。尊重患者人格

解析：医务人员在体格检查过程中，应尊重患者的人格，维护患者的自尊。医务人员要根据专业的界限依次暴露和检查一定的部位，在检查异性、畸形患者时要态度庄重，在检查敏感部位时医务人员需要用语言转移患者的注意力，男性医生在给女性患者进行妇科检查时还需要有护士或第三者在场（D对）。此外在体格检查时医生还需要做到全面系统，认真细致，关心体贴，减少痛苦（ABCE错）。